治疗顽固性呃逆的药物是
A. 地西泮
B. 异丙嗪
C. 乙琥胺
D. 氯丙嗪
E. 苯妥英钠

正确答案：D。氯丙嗪

解析：膈肌痉挛又叫呃逆，是由于膈肌、膈神经、迷走神经 或中枢神经等受到刺激后引起一侧或双侧膈肌的阵发性痉挛，伴有吸气期声门突然关闭，发出短促响亮的特别声音。如果持续痉挛超 过48小时未停止者，称顽固性膈肌痉挛，也叫顽固性呃逆。氯丙嗪通过阻断上行网状激活系统，抑制膈神经的兴奋性来实现抗呃逆作用（D对）。地西泮（A错）为苯二氮䓬类抗焦虑药，随用药量增大而具有抗焦虑、镇静催眠、抗惊厥抗癫痫及中枢性肌肉松弛作用，无抑制膈神经作用。异丙嗪（B错）是吩噻嗪类抗组胺药，也可用于镇吐、抗晕动以及镇静催眠，但无膈神经抑制作用。乙琥胺（C错）为琥珀酰胺类抗癫痫药，主要用于失神性发作和阵挛性发作，无膈神经抑制作用。苯妥英钠（E错）为抗癫痫药、抗心律失常药，无膈神经抑制作用。